基底动脉
A. 皮支分布于额叶的内侧面及底面
B. 直接参与形成大脑动脉环
C. 是颈内动脉的直接延续
D. 行至脑桥上缘分为左、右大脑后动脉
E. 是椎动脉的分支

正确答案：D。行至脑桥上缘分为左、右大脑后动脉

解析：脑的动脉来源于颈内动脉和椎动脉。 左、右椎动脉入颅后很快合并成一条基底动脉（C错），故可将脑的动脉分为颈内动脉系和椎－基底动脉系。基底动脉沿脑桥腹侧的基底沟上行，至脑桥上缘分为左、右大脑后动脉两大终支（D对）。大脑动脉环 (Willis环）由两侧大脑前动脉起始段、两侧颈内动脉末段、两侧大脑后动脉借前、后交通动脉共同组成（B错）。